在非特异的标准中，最关键的是
A. 关联强度
B. 生物学合理性
C. 结果的一致性
D. 实验证据
E. 特异性

正确答案：C。结果的一致性

解析：本题考查希尔准则的结果的一致性。在非特异的标准中，最关键的是结果的一致性（C对ABDE错）。由于同类研究结果的一致性，一致性越高，因果关系的可能性就越大，所以最关键的是结果的一致性。